可能有心功能不全存在
A. 中心静脉压很低，尿量多
B. 中心静脉压偏低，尿量少
C. 中心静脉压偏低，尿量多
D. 中心静脉压很高，尿量多
E. 中心静脉压很高，尿量少

正确答案：E。中心静脉压很高，尿量少

解析：中心静脉压代表了右心房或者胸腔段腔静脉内压力变化，可反映全身血容量与右心功能之间的关系，中心静脉压很高表示血容量充足或右心功能不全；尿量反映肾脏的灌注，尿量少提示肾灌注少，可能由心功能不全或血容量不足引起。综上，中心静脉压很高，尿量少时可能有心功能不全存在（E对）。一般不存在中心静脉压低，尿量多的临床表现（AC错）。中心静脉压偏低，尿量少（B错）为血容量不足的临床表现。中心静脉压很高，尿量多（D错）是血容量充足的临床表现。